以下符合慢性阻塞性腮腺炎临床表现的是
A. 导管口流出混浊液体
B. 导管口流出黄色凝胶状液体
C. 导管口流出草黄色或草绿色液体流出
D. 导管口可有脓性或黏液脓性唾液流出
E. 导管口流出混浊的“雪花样”或黏稠的蛋清样唾液

正确答案：E。导管口流出混浊的“雪花样”或黏稠的蛋清样唾液

解析：慢性阻塞性腮腺炎临床检查腮腺稍增大，能扪到肿大的腮腺轮廓，中等硬度，轻微压痛。导管口轻微红肿，挤压腮腺可从导管口流出混浊的“雪花样”或黏稠的蛋清样唾液，有时可见黏液栓子。病程较久者，可在颊黏膜下扪及粗硬、呈索条状的腮腺导管。掌握“慢性阻塞性腮腺炎”知识点。